以下选项中属于牙周病初级预防的是
A. 洁治治疗
B. 牙周刮治
C. 根面平整
D. X线定期追踪观察牙槽骨情况
E. 定期保健，维护口腔健康

正确答案：E。定期保健，维护口腔健康

解析：一级预防又称初级预防，是指在牙周组织受到损害之前防止致病因素的侵袭，或致病因素已侵袭到牙周组织，但尚未引起牙周病损之前立即将其去除。一级预防旨在减少人群中牙周病新病例的发生，主要是对大众进行口腔健康教育和指导，最终达到清除菌斑和其他刺激因子的目的；帮助人们建立良好的口腔卫生习惯，掌握正确的刷牙方法，同时提高宿主的抗病能力。并定期进行口腔保健，维护口腔健康。一级预防包括所有针对牙周病的病因采取的干预措施。掌握“牙周病流行病学及分级预防”知识点。